下列结构中哪个不与右心房相通
A. 肺静脉口
B. 冠状窦口
C. 上腔静脉口
D. 下腔静脉口
E. 右房室口

正确答案：A。肺静脉口

解析：肺静脉口（A错，为本题正确答案）与左心房相通。冠状窦口（B对）、上腔静脉口（C对）、下腔静脉口（D对）、右房室口（E对）均与右心房相通。